化学致癌的引发阶段，较为正确的一种描述是
A. 通过化学诱变，使细胞成为具有发展为肿瘤潜能的启动细胞的过程；引发阶段历时短，是不可逆的；引发剂有可测定的阈剂量。
B. 通过化学诱变，使细胞成为具有发展为肿瘤潜能的启动细胞的过程；引发阶段历时长，是可逆的；引发剂没有易于测定的阈剂量。
C. 通过化学诱变，使细胞成为具有发展为肿瘤潜能的启动细胞的过程；引发阶段历时短，是不可逆的；引发剂没有易于测定的阈剂量。
D. 通过化学诱变，使细胞成为具有发展为恶性前型细胞的过程；引发阶段历时短，是不可逆的；引发剂没有易于测定的阈剂量。
E. 通过化学诱变，使细胞成为具有发展为恶性前型细胞的过程；引发阶段历时短，是可逆的；引发剂有易于测定的阈剂量。

正确答案：C。通过化学诱变，使细胞成为具有发展为肿瘤潜能的启动细胞的过程；引发阶段历时短，是不可逆的；引发剂没有易于测定的阈剂量。

解析：本题考查化学致癌的过程。引发阶段为化学致癌作用的第一步骤。它通常是一相对迅速的过程，化学致癌物对靶细胞DNA产生损伤作用，经细胞分裂增殖固定下来，造成单个或少量细胞发生永久性不可逆转的遗传性改变，成为启动细胞，这就是引发阶段。具有引发作用的化学物质，称为引发剂。化学致癌的引发阶段通过化学诱变，使细胞成为具有发展为肿瘤潜能的启动细胞的过程；引发阶段历时短，是不可逆的；引发剂没有易于测定的阈剂量（C对ABDE错）。